炉甘石的条痕色是
A. 绿黑色
B. 樱红色
C. 白色
D. 黄棕色
E. 紫色

正确答案：C。白色